《温病条辨》中所列的温病不包括下述哪种疾病
A. 温热
B. 霍乱
C. 温疫
D. 暑温
E. 温毒

正确答案：B。霍乱

解析：《温病条辨》所列的温病包括风温、温热（A对）、温疫（C对）、温毒（E对）、暑温（D对）、湿温、秋燥、冬温、温疟等9种温病（B错，为本题正确答案）。这9种温病，虽然发生于不同季节，但都具有温热性质，故都属于温病的范畴。